错误的是
A. 亦称下丘脑
B. 包括视交叉、松果体、漏斗和垂体
C. 位于背侧丘脑的前下方
D. 与视神经相连
E. 无

正确答案：B。包括视交叉、松果体、漏斗和垂体

解析：丘脑下部亦称下丘脑（A对），位于背侧丘脑的前下方（C对）。从脑底面观察，终板和视交叉（D对）位于下丘脑前部，向后依次为视束、灰结节、乳头体。灰结节向前下方形成中空的圆锥状部分称漏斗，漏斗下端与垂体相连。因而下丘脑包括了视交叉、漏斗和垂体。松果体（B错，为本题正确答案）为上丘脑的结构。